对有一定工作阅历的健康教育者的培训最好采用
A. 专题讲座法
B. 参与式教学法
C. 课堂教学法
D. 示教法
E. 价值澄清法

正确答案：B。参与式教学法